下列窝洞预备的原则中，哪一项是不正确的
A. 去净腐质
B. 保护牙髓
C. 制备抗力形
D. 制备固位形
E. 窝洞点线角为钝角

正确答案：E。窝洞点线角为钝角

解析：本题考查窝洞预备的基本原则。盒状洞形是最基本的抗力形，要求窝洞底平，侧壁平面与洞底垂直，点、线角圆钝（E错，为本题的正确答案）。窝洞预备时，应去净腐质，消除感染源，以停止龋病的发展（A对）。术中必须保护牙髓组织，减少对牙髓组织的刺激（B对）。窝洞预备时要制备抗力形，以使充填体和余留的牙体组织获得足够的抗力，在承受咬合力时不折裂（C对）。窝洞预备时要制备固位形，以防止充填体在侧向或垂直方向力量作用下移位、脱落（D对）。